根尖周组织病理切片镜下可见大量中性粒细胞渗出，局部组织坏死液化，脓肿形成，并向邻近骨髓腔扩展，产生局限性的牙槽突骨髓炎属于哪期
A. 急性浆液性根尖周炎
B. 急性牙槽脓肿
C. 慢性根尖肉芽肿
D. 慢性根尖周脓肿
E. 根尖囊肿

正确答案：B。急性牙槽脓肿

解析：本题考查急慢性根尖周炎。根尖周组织病理切片镜下可见大量中性粒细胞渗出，局部组织坏死液化，脓肿形成，并向邻近骨髓腔扩展，产生局限性的牙槽突骨髓炎属于急性牙槽脓肿（B对）。急性根尖周炎可直接由急性牙髓炎向根尖周扩展而来，镜下可见有大量中性粒细胞渗出，局部组织坏死液化，脓肿形成，并向邻近骨髓腔扩展，产生局限性的牙槽突骨髓炎，此时称急性化脓性根尖周炎，也称急性牙槽脓肿。